Ⅰ型超敏反应性疾病可采用下述药物进行治疗的是
A. 生物活性介质拮抗药
B. 过敏性休克的抢救药
C. 抑制生物活性介质合成药
D. 抑制生物活性介质释放药
E. 以上说法均正确

正确答案：E。以上说法均正确

解析：对Ⅰ型超敏反应性疾病可采用下述药物进行治疗：（1）抑制生物活性介质合成和释放药。（2）生物活性介质拮抗药。（3）过敏性休克的抢救药。掌握“概述及Ⅰ型超敏反应”知识点。